芍药汤中用大黄体现的治法是
A. 上病下取法
B. 通因通用法
C. 扶正祛邪法
D. 塞因塞用法
E. 逆水挽舟法

正确答案：B。通因通用法

解析：芍药汤中用大黄体现的治法是通因通用法，即以通治通，是指用通利的药物来治疗具有通泻症状的实证。（B对）。上病下取是一种与病气上下相反的治法，指病证的表现、部位偏于上，从临床主证所在部位以下的脏腑或体表，用药物或针灸进行治疗（A错）。扶正祛邪法，扶正和祛邪是相互联系的两个方面，扶正是为了祛邪，通过增强正气的方法，驱邪外出，从而恢复健康，即所谓“正盛邪自祛”。祛邪是为了扶正，消除致病因素的损害而达到保护正气，恢复健康的目的，即所谓：“邪去正自安”（C错）。塞因塞用即以补开塞，是指用补益药物来治疗具有闭塞不通症状的虚证。适用于因体质虚弱，脏腑精气功能减退而出现闭塞症状的真虚假实证（D错）。喻嘉言用败毒散治疗外邪陷里而成之痢疾，意即疏散表邪，表气疏通，里滞亦除，其痢自止。此种治法称为“逆流挽舟”（E错）。